男性，30岁，2周来发热伴牙龈出血，查体肝肋下1cm，脾肋下3cm，胸骨压痛（+），血红蛋白60g/L，白细胞12.0×10⁹/L，血小板30×10⁹/L，骨髓象：原始细胞占64％，应进一步检查
A. 骨髓活检
B. 染色体核型分析
C. 抗血小板抗体
D. 细胞化学染色
E. 血细菌培养

正确答案：D。细胞化学染色